患者56岁，右上后牙自发性阵痛放散痛就诊。查：右上6牙体无明显磨损，未见龋坏及可疑隐裂，探查牙周，探针可及根分叉中部，牙周袋深5mm，热（++），叩（+），松动（-），X线片示近中颊侧根牙槽骨吸收至根中1/3，诊断为
A. 急性尖周炎
B. 慢性尖周炎
C. 急性牙周脓肿
D. 逆行性牙髓炎
E. 急性可复性牙髓炎

正确答案：D。逆行性牙髓炎

解析：本题考查逆行性牙髓炎。自发性阵痛放散痛为急性牙髓炎的症状，检查发现牙体组织完好说明急性牙髓炎不是由牙冠处病损引起，该患牙有根分叉病变、深牙周袋和牙槽骨吸收表面患牙伴有严重的牙周病变，有热刺激痛叩痛说明牙髓、根尖区有炎症，由此可见患牙未有逆行性牙髓炎（D对）。急性根尖周炎（A错）、慢性根尖周炎（B错）牙体应有明显缺损，可见龋坏或隐裂。急性牙周脓肿（C错）无牙髓炎症状，牙髓活力一般正常，松动度明显。急性可复性牙髓炎（E错）冷热刺激一过性疼痛，刺激去除后疼痛立即消失，无自发性阵痛放散痛症状。